老年男性，65岁，因牙列缺损到修复科就诊，目的恢复咀嚼功能。检查见双侧上颌磨牙缺失，上颌牙槽嵴低平，拟行可摘局部义齿进行修复。则在排牙的时候应该将人工牙排列成
A. 尖对尖
B. 正常（牙合）
C. 反（牙合）
D. 靠近唇侧
E. 靠近腭侧

正确答案：C。反（牙合）

解析：单侧或双侧多数牙游离缺失，后牙应排在牙槽嵴上。如上颌牙槽骨吸收较多，应排成反（牙合）关系。否则，排在牙槽嵴的颊侧过多，可加速牙槽骨吸收，并影响义齿固位，且易造成基托折裂。掌握“局部义齿颌位关系记录及人工牙选择”知识点。